开展社区卫生服务的理论基础是
A. 临床医学
B. 预防医学
C. 行为医学
D. 社会医学
E. 全科医学

正确答案：E。全科医学